男，17岁。骑摩托车时不慎摔倒，左颅顶着力，短暂昏迷后清醒。伤后30分钟送医院，急诊头颅CT示左颅顶颅骨骨折。2小时后头痛加剧，逐渐昏迷，左侧瞳孔散大，右侧肢体瘫痪。应采取的有效治疗措施是
A. 立即收入病房，观察生命征变化
B. 应用抗生素
C. 急诊行血肿清除减压术
D. 立即应用降颅压药物
E. 急诊行颈椎牵引术

正确答案：C。急诊行血肿清除减压术

解析：青少年男性患者，头部外伤史（颅内血肿的常见原因）。短暂昏迷后清醒，之后逐渐昏迷（昏迷→中间清醒或好转→昏迷，为硬膜外血肿的典型表现）。头颅CT示左颞顶颅骨骨折。左侧瞳孔散大，右侧肢体瘫痪（小脑幕切迹疝的典型表现）。综合患者病史、临床表现和影像学检查，应诊断为左颞顶颅骨骨折；急性硬脑膜外血肿并发小脑幕切迹疝，应采取的有效治疗措施是急诊行血肿清除减压术（C对），以降低颅内压，缓解病情。立即收入病房，观察生命征变化（A错）适用于伤后无明显意识障碍，病情稳定的颅内压增高的患者。应用抗生素（B错）可作为术前或术后的辅助治疗，以预防感染，但不能缓解脑疝引起的症状。立即应用降颅压药物（D错）可以缓解颅内压增高的症状，为手术争取时间，多作为急救措施。颈椎牵引术（E错）主要用于治疗神经根型颈椎病，对硬膜外血肿引起的脑疝无治疗效果。